过量服用维生素D所发生中毒的典型临床表现是
A. 骨骼发育不良或骨软化
B. 间质性肾炎或肾结石
C. 骨质疏松症或骨折
D. 横纹肌溶解或肌痛
E. 高尿酸血症或疼痛

正确答案：B。间质性肾炎或肾结石

解析：本题考查维生素D过量服用的不良反应。过量服用维生素D所发生中毒的典型临床表现是间质性肾炎或肾结石（B对）。维生素D缺乏可导致骨骼发育不良或骨软化（A错）、骨质疏松症或骨折（C错）。羟甲基戊二酰辅酶-A还原酶抑制剂可能导致横纹肌溶解或肌痛（D错）。高尿酸血症或疼痛（E错）常见于痛风。